以下边缘类型中强度最差的是
A. 刃状
B. 90°肩台
C. 90°肩台加斜面
D. 凹面
E. 135°肩台

正确答案：A。刃状

解析：本题考查修复体龈边缘外形的选择应用。修复体的边缘形态包括：刃状，斜面，凹槽（凹面），深凹槽，肩台（90°肩台，135°肩台），带斜坡肩台（90°肩台加斜面）。其中刃状边缘（A对）磨除的牙体组织最少，边缘最薄，故强度最差。90°肩台（B错）、90°肩台加斜面（C错）、凹面（D错）、135°肩台（E错）磨除量均比刃状边缘厚，自然强度也高。